我国的药品标准有
A. 《中国常用药品集》
B. 《中华人民共和国药典》
C. 《中华人民共和国卫生部药品标准》
D. 《国家食品药品监督管理局药品标准》
E. 《中华人民共和国药典临床用药须知》

正确答案：B、C、D。《中华人民共和国药典》；《中华人民共和国卫生部药品标准》；《国家食品药品监督管理局药品标准》

解析：本题考查的是药品标准。我国的药品标准有《中华人民共和国药典》（B对）、《中华人民共和国卫生部药品标准》（C对）与《国家食品药品监督管理局药品标准》（D对）。药品标准有：1.《中华人民共和国药典》（2015年版）；2.《中华人民共和国卫生部标准》《国家食品药品监督管理局标准》及其他。《中国常用药品集》（A错）、《中华人民共和国药典临床用药须知》（E错）属于常用药品集和专著。常用药品集和专著：1.《中华人民共和国药典临床用药须知》；2.《中华本草》；《中国中药资源志要》；4.《中国常用药品集》；5.《中国药品使用手册•中成药专册》（2002年版）；6.《全国中草药汇编》。